健康监护的内容不包括
A. 就业前体检
B. 定期体检
C. 劳动能力鉴定
D. 职业流行病学调查
E. 建立健康监护档案

正确答案：D。职业流行病学调查